乳牙萌出的顺序是
A. ⅤⅠⅡⅢ Ⅳ
B. ⅠⅡⅤⅣⅢ
C. ⅠⅡⅣⅢⅤ
D. ⅠⅡⅢⅤⅣ
E. ⅠⅡⅤⅢ Ⅳ

正确答案：C。ⅠⅡⅣⅢⅤ

解析：本题考查乳牙的萌出顺序。乳牙萌出的顺序：ⅠⅡⅣⅢⅤ（C对）。乳牙从出生6-7个月中切牙开始萌出到2岁半左右全部乳牙萌出，大约需要1年6个月至2年时间。牙齿萌出有一定的顺序，萌出顺序紊乱，常导致错（牙合）畸形的发生。